具有受纳水谷功能的是
A. 三焦
B. 膀胱
C. 胆
D. 胃
E. 小肠

正确答案：D。胃

解析：胃具有接受和容纳饮食的生理功能。饮食入口，经过食道，到达于胃，由胃来容纳（D对）；三焦的生理功能为通行元气，运行水液（A错）；膀胱的主要生理功能是贮尿和排尿（B错）；胆主要的生理功能是贮藏和排泄胆汁（C错）；小肠的主要生理功能是主受盛化物和泌别清浊（E错）。